选择手法复位石膏固定的是
A. 肩关节脱位
B. 儿童锁骨青枝骨折
C. 神经根型颈椎病
D. 桡骨头半脱位
E. 桡骨头远端骨折

正确答案：E。桡骨头远端骨折

解析：选择手法复位，石膏固定的是桡骨头远端骨折（E对）。肩关节脱位一般手法复位，用三角巾悬吊（A错）。儿童锁骨青枝骨折可不作特殊治疗（B错）。神经根型颈椎病一般情况下用颈椎牵引、颈部制动、颈部理疗进行治疗即可（C错）。桡骨头半脱位一般手法复位，悬吊患肢即可，复位后不必固定（D错）。